小范围、短时间内相同病例数的突然增多现象，可能是
A. 散发
B. 暴发
C. 流行
D. 大流行

正确答案：B。暴发

解析：本题考查暴发的概念。暴发（B对ACD错）是指局部地区或集体单位，短时间内突然发生很多症状相同病人的现象。这些人多有相同的传染源或传播途径。大多数病人常同时出现在该病的最短和最长潜伏期之间。